女性，50岁，因牙周病拔除下颌86│34三个月余，下颌5│无可利用倒凹，Ⅰ～Ⅱ°松动，余牙正常。可摘局部义齿修复时，右侧固位体应采用
A. 倒钩卡环
B. 对半卡环
C. 延伸卡环
D. RPI卡环
E. RPA卡环

正确答案：C。延伸卡环

解析：本题考查局部义齿的设计。该题的倒钩卡环（A错）、RPI卡环（D错）和RPA卡环（E错）用于缺隙相邻基牙，但因为下颌5│无可利用倒凹，如果采用这三种卡环，将无固位作用。对半卡环（B错）通常用于前后均有缺隙的孤立前磨牙。该病例得到的情况正是延伸卡环（C对）的适应证。延伸卡环的卡环臂从下颌5│继续向前延伸到下颌4│，进入下颌4│颊侧倒凹以获得固位，该卡环有夹板固定作用，可稳定松动的下颌5│。